按刑法规定，属于扰乱市场秩序罪，情节特别严重，应处五年以上有期徒刑，并处违法所得一倍以上五倍以下罚金或没收财产的犯罪行为是
A. 广告主、广告经营者、广告发布者违法国家规定，利用广告对商品或服务虚假宣传的
B. 未经许可经营法律、行政法规规定的专营、专卖物品或者其他限制买卖的物品的
C. 买卖进出口许可证以及其他法律、行政法规规定的经营许可证或者批准文件的
D. 其他严重扰乱市场秩序的非法经营行为的
E. 以暴力、威胁方法阻碍国家机关工作人员依法执行职务的

正确答案：B、C、D。未经许可经营法律、行政法规规定的专营、专卖物品或者其他限制买卖的物品的；买卖进出口许可证以及其他法律、行政法规规定的经营许可证或者批准文件的；其他严重扰乱市场秩序的非法经营行为的

解析：本题考查扰乱市场秩序。《中华人民共和国刑法》第二百二十五条：违反国家规定，有下列非法经营行为之一，扰乱市场秩序，情节严重的，处五年以下有期徒刑或者拘役，并处或者单处违法所得一倍以上五倍以下罚金；情节特别严重的，处五年以上有期徒刑，并处违法所得一倍以上五倍以下罚金或者没收财产：（一）未经许可经营法律、行政法规规定的专营、专卖物品或者其他限制买卖的物品的（B对）；（二）买卖进出口许可证、进出口原产地证明以及其他法律、行政法规规定的经营许可证或者批准文件的（C对）；（三）未经国家有关主管部门批准，非法经营证券、期货或者保险业务的，或者非法从事资金支付结算业务的；（四）其他严重扰乱市场秩序的非法经营行为（D对）。